8月小儿体检时发现胸骨左缘2～3肋间闻及Ⅲ级左右连续机器样杂音，向颈部锁骨下传导，可触及震颤。胸部X线示：左心房室增大，肺血管影增多，肺动脉段突出，主动脉弓增大。此患儿最可能的诊断是
A. 房间隔缺损
B. 室间隔缺损
C. 肺动脉狭窄
D. 法洛氏四联症
E. 动脉导管未闭

正确答案：E。动脉导管未闭

解析：根据该患儿的体格检查胸骨左缘2-3肋间的“机器”样杂音和胸部X线的表现即可判定为动脉导管未闭（E对）。房间隔缺损是由于原始心房间隔发育、融合、吸收等异常所致，缺损时出现左向右分流，症状的早晚和严重程度取决于缺损的大小，听诊时以第一心音亢进，第二心音固定分裂为特点（A错）。室间隔缺损体格检查时听到胸骨左缘第3、4肋间响亮的全收缩期杂音，常伴震颤，肺动脉第二心音正常或稍强（B错）。肺动脉瓣狭窄时轻中度狭窄时心脏大小正常；重度狭窄时如心功能尚可，心脏仅轻度增大；如有心力衰竭，心脏明显增大，主要为右心室和右心房扩大。狭窄后的肺动脉扩张为本病特征性的改变（C错）。法洛氏四联症是婴儿期后最常见的青紫型先天性心脏病，主要表现为青紫、蹲踞症状、杵状指和阵发性缺氧发作，X线检查心影呈“靴状”。体格检查时一般无收缩期震颤（D错）。